在体内可发生O-脱甲基代谢，使失去活性的药物是
A. 沙丁胺醇
B. 肾上腺素
C. 非尔氨酯
D. 吲哚美辛
E. 醋磺己脲

正确答案：D。吲哚美辛

解析：本题考查吲哚美辛。在体内可发生O-脱甲基代谢，使失去活性的药物是吲哚美辛（D对）。醚类药物在肝微粒体混合酶的作用下，进行氧化O-脱烷基化反应，生成醇或酚，以及羰基化合物。吲哚美辛经代谢失活，在体内约有50%经O-脱甲基代谢，生成无活性的化合物，有10%代谢物与葡萄糖醛酸结合，排出体外。酚羟基在形成硫酸酯化结合反应时，具有较高的亲和力，反应较为迅速。如支气管扩张药沙丁胺醇（A错），结构中有三个羟基，只有其中的酚羟基形成硫酸酯化结合物，而脂肪醇羟基硫酸酯化结合反应较低，且形成的硫酸酯易水解成为起始物。肾上腺素（B错）经儿茶酚-O-甲基转移酶（COMT）快速甲基化后生成3-O-甲基肾上腺素，活性降低。钠通道阻滞药非尔氨酯（C错）具有镇静催眠和抗癫痫作用，曾因可引起肝脏毒性和再生障碍性贫血而被限制使用。该药物首先在体内被酯酶水解并被醛脱氢酶催化下生成醛基氨甲酸酯，在发生分子内环合生成环唑啉酮，环唑啉酮脱氢生成强亲电性的2-苯基丙烯醛，易与蛋白的亲核基团发生迈克尔加成，产生特质性毒性。口服降糖药醋磺己脲（E错）发生脂环的氧化反应，主要代谢产物是反式4-羟基醋磺己脲。